胎盘绒毛与子宫血窦之间的屏障称为
A. 血脑屏障
B. 一级消除动力学
C. 二级消除动力学
D. 零级消除动力学
E. 胎盘屏障

正确答案：E。胎盘屏障

解析：胎盘绒毛与子宫血窦之间的屏障称为胎盘屏障。掌握“药物的吸收和分布”知识点。